以下哪种情况属于染色体整倍性畸变
A. n
B. 2n
C. 3n
D. 上述AC都是

正确答案：D。上述AC都是

解析：本题考查染色体整倍性畸变。染色体整倍性畸变是指染色体数目以染色体组为单位的增减，如n，3n（D对ABC错）。